软胶囊填充物的分散介质为PEG-400时，其助悬剂应选用
A. PEG-6000
B. 大豆油
C. 蜂蜡
D. 亚硫酸氢钠
E. 油蜡混合物

正确答案：A。PEG-6000

解析：本题考查的是软胶囊对填充物料的要求。软胶囊填充物的分散介质为PEG-400时，其助悬剂应选用PEG-6000（A对）。软胶囊对填充物料的要求：软胶囊可填充各种油类或对囊壁无溶解作用的药物溶液或混悬液，也可充填固体药物。填充物料为低分子量水溶性或挥发性有机物（如乙醇、丙酮、羧酸等）或充填药物的含水量超过5%，会使软胶囊溶解或软化；醛类可使囊膜中明胶变性；O/W型乳剂会失水破坏，均不宜作为软胶囊的填充物。填充药物混悬液时，分散介质常用植物油（B错）或PEG 4000。油状介质常用10%～30%的油蜡混合物（E错）作助悬剂，而非油状介质则常用1%～15% PEG 4000或PEG 6000。必要时可加用抗氧剂、表面活性剂等附加剂。填充液pH应控制在4.5～7.5之间，强酸性可导致明胶水解而泄漏，强碱性可引起明胶变性而影响溶解释放。填充固体药物时，药粉应过五号筛，并混合均匀。蜂蜡（C错）可作软膏剂的基质。蜂蜡：有黄蜡、白蜡之分。白蜡系由黄蜡漂白精制而成，主要成分为棕榈酸蜂蜡醇酯，熔点为62℃～67℃。常用调节软膏的稠度或增加稳定性。因含有少量的游离高级脂肪醇而有乳化作用，可作辅助乳化剂。亚硫酸氢钠（D错）可作注射剂的抗氧化剂。抗氧剂是一类易被氧化的还原剂。常用抗氧剂有亚硫酸钠、亚硫酸氢钠和焦亚硫酸钠等，一般浓度为0.1%～0.2%。其中亚硫酸钠常用于偏碱性药液，亚硫酸氢钠和焦亚硫酸钠常用于偏酸性药液。